光化学烟雾发生时受害者的主要症状是
A. 咳嗽、胸痛、呼吸困难
B. 眼睛红肿、流泪、咽喉痛
C. 头痛、恶心、皮肤潮红
D. 恶心、呕吐、呼吸急促
E. 咳嗽、头痛、胸痛

正确答案：B。眼睛红肿、流泪、咽喉痛

解析：本题考查光化学烟雾事件的症状。光化学烟雾发生时受害者的症状是：眼睛红肿流泪、咽喉痛（B对ACDE错）、咳嗽、喘息、呼吸困难、头痛 、胸痛、疲劳感和皮肤潮红等，严重者可出现心肺功能障碍或衰竭。